幼儿急疹邪郁肺卫证首选的方剂是
A. 银翘散
B. 清解透表汤
C. 宣毒发表汤
D. 解肌透疹汤
E. 透疹凉解汤

正确答案：A。银翘散

解析：幼儿急疹邪郁肺卫证首选的方剂是银翘散，邪郁肺卫证以发热为主症。临床以突起高热，持续3～4天，一般情况良好为特征。治法为辛凉解表。选方银翘散加减（A对）。邪入肺胃证用清解透表汤（B错）。麻毒时邪由口鼻而入犯肺、肺卫失宣，故见发热、咳嗽、鼻塞、流涕等肺卫之证，此为前驱期选方宣毒发表汤（C错）。解肌透疹汤主治痧麻初起，恶寒发热，咽喉肿痛，妨于咽饮，遍体，痛，烦闷呕恶（D错）。透疹凉解汤主治风痧（E错）。